被评价者的实际年龄41岁，评价年龄44岁，增长年龄35岁，此被评者属于
A. 健康型
B. 自创性危险因素型
C. 一般性危险型
D. 难以改变的危险因素型
E. 少量危险型

正确答案：B。自创性危险因素型